体积较小的乳头是
A. 丝状乳头
B. 菌状乳头
C. 轮廓乳头
D. 叶状乳头
E. 以上都不是

正确答案：A。丝状乳头

解析：丝状乳头：数目最多，乳头表面有透明角化上皮细胞。上皮的浅层细胞经常有角化和剥脱现象。掌握“口腔黏膜分类及组织结构”知识点。